酒精肝病患者肝脏可逆性损伤常表现
A. 细胞水肿
B. 脂肪变
C. 玻璃样变
D. 淀粉样变
E. 黏液样变

正确答案：B。脂肪变

解析：酒精性肝病是慢性酒精中毒的主要表现之一，患者肝脏可逆性损伤常表现为脂肪变性（B对）。细胞水肿（A错）常见于病毒性肝炎（P197）。玻璃样变（C错）可见于酒精性肝病，形成Mallory小体，但不如脂肪变性常见。淀粉样变（D错）和黏液样变（E错）虽为可逆性损伤，但均不常见于酒精性肝病。